高温环境人群的营养重点是在膳食中应增加
A. 能量
B. 膳食纤维
C. 水和矿物质
D. 蛋白质和脂肪
E. 脂肪和维生素

正确答案：C。水和矿物质

解析：本题考查高温环境人群的膳食营养重点。高温环境中的膳食营养重点是增加水和矿物质（C对ABDE错）的摄入，也应适量增加蛋白质、碳水化合物和维生素的摄入量，并控制脂肪的摄入量；同时，应注意选择清淡易消化的食物。